肾小管性酸中毒
A. AG增高性代谢性酸中毒
B. AG正常性代谢性酸中毒
C. 两者均有
D. 两者均无
E. 无

正确答案：B。AG正常性代谢性酸中毒

解析：发生肾小管性酸中毒时，机体重吸收HC03-减少或泌H+障碍，导致HC03-浓度降低，同时伴有Cl-浓度代偿性升高，固定酸浓度不变，所以肾小管性酸中毒为AG正常型代谢性酸中毒（B对）。